流行病学实验中盲法指
A. 研究对象不知分组情况
B. 观察者不知分组情况
C. 研究控制人员不知分组情况
D. 研究者和/或研究对象和/或研究控制人员不知分组情况
E. 研究对象均是盲人

正确答案：D。研究者和/或研究对象和/或研究控制人员不知分组情况